输尿管第一个狭窄位于
A. 与髂血管交叉处
B. 输尿管起始处
C. 与输精管相交处（男性）
D. 斜穿膀胱壁处
E. 与子宫动脉交叉处（女性）

正确答案：B。输尿管起始处

解析：输尿管全程有 3 处狭窄，其中第一个狭窄为上狭窄，位于肾盂输尿管移行处，即输尿管起始处（B对）。